患者男，60岁。1年来反复咯血，咳痰粘稠，低热伴消瘦，活动后气短，乏力。X线胸片示：右肺上叶段片状及条索状阴影，并有透亮区，胸廓下陷，气管右移。应首先考虑的诊断是
A. 原发性支气管肺癌
B. 血行播散型肺结核
C. 纤维空洞性肺结核
D. 浸润性肺结核
E. 干酪阳肺炎

正确答案：C。纤维空洞性肺结核

解析：患者男，60岁，1年来反复咯血，咳痰粘稠（咳嗽，咯痰，咳血的呼吸系统症状），低热伴消瘦（全身中毒症状），活动后气短，乏力（呼吸困难的呼吸系统症状）。X线胸片示右肺上叶段片状及条索状阴影（上叶尖后段或下叶背段为肺结核好发部位），并有透亮区（空洞即形成不同形状的透亮区），胸廓下陷，气管右移（患侧肺组织收缩，纵隔牵向患侧）（C对）。肺癌常有刺激性咳嗽、痰中带血或咯血、胸痛及进行性消瘦等症状，多见于中老年嗜烟男性，常无明显全身中毒症状。X线胸片示癌肿呈分叶状，病灶边缘常有切迹、毛刺。胸部CT扫描、痰结核杆菌、脱落细胞检查及纤维支气管镜检查及活检等有助于鉴别。肺癌与肺结核并存时需注意发现（A错）。急性血行播散型肺结核多见于婴幼儿和青少年，特别是抵抗力低下的小儿，起病急，有高热等中毒症状，全身浅表淋巴结肿大，肝脾肿大，常伴发结核性脑膜炎。X线胸片显示肺内大小、密度、分布均匀的粟粒状结节阴影。亚急性及慢性血行播散型肺结核起病缓慢，症状较轻常为间歇性低热、盗汗、乏力、轻度咳嗽等，部分患者无或仅有轻度中毒症状。X线胸片呈现大小不一，病灶新鲜、陈旧不等，分布不均匀的粟粒状结节阴影（B错）。浸润性肺结核早期往往无明显症状及体征，常由健康检查而发现。病灶多位于锁骨上下，X线胸片显示为片状、絮状阴影，边缘模糊（D错）。干酪样肺炎多发生于免疫力低下，又受到大量结核杆菌感染的患者，或有淋巴结支气管瘘，淋巴结中大量干酪样物质经支气管进入肺内而发生。X线胸片呈肺大叶密度均匀的磨玻璃状阴影，或是小叶斑片播散病灶（E错）。